基因组最小的动物病毒是
A. EBV
B. HAV
C. HDV
D. HSV
E. HIV

正确答案：C。HDV

解析：丁型肝炎病毒（HDV）为球状，直径为35～37nm，核心为单股负链RNA（-ssRNA），基因组仅有1.7kb长，是已知动物病毒中最小的基因组。掌握“丙型、丁型、戊型肝炎病毒”知识点。